新生儿期计划免疫应接种的疫苗是
A. 骨髓灰质炎丸与百白破三联合疫苗
B. 卡介苗与百白破三联混合疫苗
C. 卡介苗与乙肝疫苗
D. 乙肝疫苗与麻疹疫苗
E. 骨髓灰质炎糖丸与麻疹疫苗

正确答案：C。卡介苗与乙肝疫苗

解析：新生儿期是自胎儿娩出脐带结扎开始至生后28天之前。根据P27表3-1可知，新生儿期计划免疫应接种的疫苗是卡介苗与乙肝疫苗（C对）。现将我国儿童计划免疫总结成口诀为：“一月乙肝卡介苗，二月脊髓灰正好，三四五月百白破，八月麻疹岁乙脑”（ABDE错）。